某幽门梗阻患者，因反复呕吐入院，血气分析结果如下pH7.49,PaCO₂6.4kPa(48mmHg),HCO₃⁻36mmoI/L,可诊断为
A. 呼吸性酸中毒
B. 代谢性酸中毒
C. 代谢性碱中毒
D. 代谢性碱中毒合并呼吸性酸中毒
E. 呼吸性碱中毒

正确答案：C。代谢性碱中毒

解析：幽门梗阻由于胃无法排空易导致剧烈呕吐使富含HCl的胃液大量丢失而发生代谢性碱中毒（C对）。由于酸性物质丢失，血浆HCO₃⁻浓度上升（正常为22~27 mmoI/L），PH上升（正常值为7.35~7.45），PH上升导致呼吸中枢受抑制，呼吸变浅变慢，肺泡通气量减少，PaC02继发性升高（正常范围为33~46 mmHg）。